女，左乳3cm×3cm肿块，质硬，光滑，可推动，无淋巴结肿大，首选检查是
A. 乳腺X线检查
B. 乳腺导管检查
C. 乳腺B超
D. CT
E. MRI

正确答案：C。乳腺B超

解析：该患者女，左乳出现3cm×3cm肿块，质硬，光滑，可推动，无淋巴结肿大，首选应行乳腺B超检查，乳腺B超可以检出囊性病变，观察血供情况，提高判断的敏感性，也可以对肿瘤的定性诊断提供有价值的依据（C对）。乳房X线摄影是常用的影像学检查方法，广泛用于乳腺癌的普查。乳腺癌的X线表现为密度增高的肿块影，边界不规则，或呈毛刺征。有时可见钙化点，颗粒细小、密集（A错）。乳头溢液未抇及肿块者，可作乳腺导管内视镜检查（B错）。MRI是乳腺X线摄影和超声检查的重要补充，对微小病灶、多中心、多病灶的发现及评价病变范围有优势（E错）。